川牛膝的药用部位是
A. 根
B. 根茎
C. 块根
D. 鳞茎
E. 根及根茎

正确答案：A。根